强效、速效、长效的红内期裂殖体杀灭剂
A. 氯喹
B. 青蒿素
C. 乙胺嘧啶
D. 伯氨喹
E. 奎宁

正确答案：A。氯喹